微循环中参与体温调节的是
A. 迂回通路
B. 毛细血管前括约肌
C. 动-静脉短路
D. 直捷通路
E. 微动脉

正确答案：C。动-静脉短路